职业肿瘤是指
A. 由生产性毒物引起的肿瘤
B. 由物理因素引起的肿瘤
C. 由化学因素引起的肿瘤
D. 由致癌因素引起的肿瘤
E. 由职业性致癌因素引起的肿瘤

正确答案：E。由职业性致癌因素引起的肿瘤

解析：本题考查职业肿瘤的概念。职业性肿瘤，是在工作环境中接触致癌因素，经过较长的潜隐期而罹患的某种特定肿瘤（E对ABCD错）。在一定条件下能使正常细胞转化为肿瘤细胞，且能发展为可检出肿瘤的与职业有关的致病因素，称为职业性致癌因素。